王某，女，19岁。最近因高考失利而出现情绪低落和失眠的情况。王某的母亲知道王某有位表哥是心理治疗师，比较熟悉和了解王某的情况，要求其给王某做心理治疗，但被这位表哥拒绝了。其表哥拒绝提供治疗服务所依据的原则为
A. 保密原则
B. 回避原则
C. 发展原则
D. 灵活原则
E. 中立原则

正确答案：B。回避原则

解析：心理治疗四大原则为保密原则、中立原则、回避原则、真诚原则。回避原则（B对）是指心理咨询及治疗中设计患者个人隐私问题，熟人及家属应回避，该题中，表哥是患者的熟人，应注意回避。保密原则（A错）是心理咨询最为重要的原则，要求在未经对方同意的时候，不得将在咨询场合下对方的言行随意泄露给任何人和机关。中立原则（E错）是指治疗者对治疗中设计的各类事件均应保持客观、中立的立场，不把个人观点强加于患者。